下牙槽神经阻滞麻醉注射时注射针应高于下颌（牙合）平面
A. 0.5cm
B. 1cm
C. 1.5cm
D. 2cm
E. 3cm

正确答案：B。1cm

解析：下牙槽神经阻滞麻醉注射方法：病员大张口，下颌（牙合）平面与地面平行，将注射器放在对侧口角，即第一、第二前磨牙之间，与中线成45°角。注射针应高于下颌（牙合）平面1cm并与之平行。按上述的刺入点标点进针2.5cm左右，可达下颌骨骨面的下牙槽神经沟。回抽无血，即可注入麻药1～1.5ml。约5分钟后，病员即感同侧下唇口角麻木、肿胀，探刺无痛。掌握“颌面部常用局麻法及牙拔除的麻醉选择”知识点。